含有砷、汞等矿物类成分的中成药，长期服用、可造成血尿、蛋白尿等肾功能损害肾功能不全患者应慎用。同时含有砷、汞等矿物类成分的中成药是
A. 人参再造丸
B. 苏合香丸
C. 安宫牛黄丸
D. 天王补心丸
E. 牛黄解毒丸

正确答案：C。安宫牛黄丸

解析：本题考查的是对肾功能有影响的矿物类中药。含有砷、汞等矿物类成分的中成药，长期服用、可造成血尿、蛋白尿等肾功能损害肾功能不全患者应慎用。同时含有砷、汞等矿物类成分的中成药是安宫牛黄丸（C对）。常见对肾功能有影响的矿物类中药：（1）含砷类：砒石、砒霜、雄黄、红矾，以及中成药牛黄解毒片（E错）、安宫牛黄丸、牛黄清心丸、六神丸、砒枣散等，均含砷元素，服用后使中枢神经中毒，产生一系列中毒症状，临床表现有剧烈恶心、呕吐、腹痛、腹泻等消化系统症状和转氨酶升高、黄疸、血尿、蛋白尿等肝肾功能损害。（2）含汞类：朱砂、升汞、轻粉、红粉，以及中成药安宫牛黄丸、牛黄清心丸、朱砂安神丸、天王补心丸（D错）、安神补脑丸、苏合香丸（B错）、人参再造丸（A错）、大活络丸、七厘散、梅花点舌丸、一捻金（胶囊）等，均含汞元素。过量服用可产生各种中毒症状。泌尿系统表现为少尿、蛋白尿，严重者可致急性肾功能衰竭。